使用质子泵抑制剂会增加特定感染类型感染的发生风险，使用期间需要关注的感染类型包括
A. 胃肠道感染
B. 泌尿系统感染
C. 呼吸系统感染
D. 皮肤感染
E. 中枢神经系统感染

正确答案：A、C。胃肠道感染；呼吸系统感染

解析：本题考查质子泵抑制剂的不良反应。使用质子泵抑制剂会增加胃肠道感染（A对）和呼吸系统感染（C对）。